患者，女，6岁，因发热（38.6℃）、头痛、鼻塞、流清涕、咳嗽、无痰就诊。实验室检查：白细胞、中性粒细胞计数正常。临床诊断为普通感冒。治疗该患者咳嗽，首选的药物是
A. 可待因
B. 乙酰半胱氨酸
C. 溴已新
D. 右美沙芬
E. 氨溴索

正确答案：D。右美沙芬

解析：本题考查感冒药。治疗该患者咳嗽，首选的药物是右美沙芬（D对）。对感冒所伴随的咳嗽，有多种右美沙芬复方制剂可选用，如氨酚伪麻美芬片Ⅱ／氨麻苯美片、美扑伪麻片、酚麻美敏片、双酚伪麻、美息伪麻、伪麻美沙芬等制剂，应避免合并用药。可待因（A错）尤其适用于伴有胸痛的干咳患者，12岁以下儿童禁用。乙酰半胱氨酸（B错）、溴已新（C错）、氨溴索（E错）为祛痰药。